病情凶险者，指纹的表现是
A. 显于风关
B. 达于气关
C. 达于命关
D. 透关射甲
E. 未超风关

正确答案：D。透关射甲

解析：该题考查望小儿指纹，为望诊重点内容。从食指掌侧前缘，掌指横纹附近至食指端，表示病情由浅入深，病情逐渐加重。